下列属于精神科急诊范畴的是
A. 幻觉妄想
B. 情感不稳
C. 伤人毁物
D. 意志缺乏
E. 无自知力

正确答案：C。伤人毁物